发热时体温每升高1℃基础代谢率一般可提高
A. 0.03
B. 0.05
C. 0.1
D. 0.13
E. 0.15

正确答案：D。0.13

解析：体温升高时物质代谢加快。体温每升高1°C，基础代谢率提高13%（D对），所以发热患者的物质消耗明显增多。